“既来之，则安之”，遵行医嘱，主动采取必要的措施减轻病痛，这属于患者角色转变中的
A. 角色行为适应
B. 角色行为缺如
C. 角色行为冲突
D. 角色行为强化
E. 角色行为减退

正确答案：A。角色行为适应

解析：角色行为适应：患者基本上已与患者角色的“指定心理活动和行为模式”相符合。表现为比较冷静，客观地面对现实。“既来之，则安之”，关注自身的疾病，遵行医嘱，主动采取必要的措施减轻病痛。掌握“患者角色和求医行为”知识点。